许多性传播疾病可经胎盘、产道等途径由母亲传给胎儿或新生儿，这种传播途径称为
A. 血液传播
B. 医源性传播
C. 日常生活接触传播
D. 垂直传播
E. 性接触传播

正确答案：D。垂直传播

解析：本题考查垂直传播。垂直传播（D对ABCE错）又称母婴传播，是指梅毒、淋病、AIDS、乙型肝炎、衣原体感染等多种STDs病原体经胎盘、产道、哺乳等途径由母亲传给胎儿或新生儿的传播途径。